描述性研究具有的特征是
A. 以个体为单位收集和分析资料
B. 选择不同性质的人群进行对比
C. 被调查人群是以随机抽样的方式获得的
D. 描述疾病分布的特点，可提供疾病的病因线索
E. 论证强度高，可以验证病因假设

正确答案：D。描述疾病分布的特点，可提供疾病的病因线索

解析：本题考查描述性研究具有的特征。描述性研究是指利用常规监测记录或通过专门调查获得的数据资料（包括实验室检查结果），按照不同地区、不同时间及不同人群特征进行分组，描述人群中有关疾病或健康状态以及有关特征和暴露因素的分布状况，在此基础上进行比较分析，获得疾病三间（人群、地区和时间）分布的特征，进而获得病因线索，提出病因假设（D对ABCE错）。